工作负荷评价的主要目的是
A. 减轻工作负荷
B. 提高工作负荷
C. 消除工作负荷
D. 将工作负荷降低到尽可能低的水平
E. 将工作负荷维持在适当的水平

正确答案：E。将工作负荷维持在适当的水平